某男，64岁。喘促日久，动则喘甚，呼多吸少，气不得续，小便常因咳甚而失禁，尿有余沥，形瘦神疲，汗出肢冷，面唇青紫；舌淡苔薄，脉沉弱。宜选用的基础方剂是
A. 桑白皮汤
B. 三子养亲汤
C. 越婢加半夏汤
D. 肾气丸
E. 苏子降气汤

正确答案：D。肾气丸

解析：本题考查的是喘证的辨证论治。喘促日久，动则喘甚，呼多吸少，气不得续，小便常因咳甚而失禁，尿有余沥，形瘦神疲，汗出肢冷，面唇青紫；舌淡苔薄，脉沉弱。宜选用的基础方剂是肾气丸（D对）。喘即气喘、喘息。喘证是以呼吸困难，甚至张口抬肩、鼻翼扇动、不能平卧为特征的疾病。西医学的肺炎、支气管炎、肺气肿、肺源性心脏病、心源性哮喘以及癔病等发生呼吸困难时，可参考此内容辨证论治。（一）风寒闭肺证：【症状】喘咳气逆，呼吸急促，胸部胀闷，痰多色白稀薄而带泡沫，兼头痛鼻塞、无汗、恶寒、发热，舌苔薄白而滑，脉浮紧。【方剂应用】基础方剂为麻黄汤（麻黄、杏仁、桂枝、炙甘草）合华盖散（麻黄、杏仁、桑白皮、紫苏子、茯苓、陈皮）加减。（二）痰热壅肺证：【症状】喘咳气涌，胸部胀痛，痰稠黏色黄，或夹血痰，伴胸中烦闷、身热、有汗、口渴喜冷饮、咽干、面红、尿赤、便秘。舌质红，苔薄黄腻，脉滑数。【方剂应用】基础方剂为桑白皮汤（A错）（桑白皮、半夏、苏子、苦杏仁、贝母、黄芩、黄连、栀子）加减。（三）痰浊阻肺证：【症状】喘而胸满闷塞，甚则胸盈仰息，咳嗽，痰多黏腻色白，咳吐不利，兼有呕恶，食少，口黏不渴。舌苔白腻，脉滑或濡。【方剂应用】基础方剂为二陈汤（陈皮、半夏、茯苓、甘草、生姜、乌梅）合三子养亲汤（B错）（紫苏子、白芥子、莱菔子）加减。（四）肾不纳气证：【症状】喘促日久，动则喘甚，呼多吸少，气不得续，小便常因咳甚而失禁，或尿后余沥，形瘦神疲，汗出肢冷，面唇青紫，或有跗肿，舌淡苔薄，脉沉弱；或见喘咳，面红烦躁，口咽干燥，足冷，汗出如油。舌红少津，脉细数。【方剂应用】基础方剂为肾气丸（桂枝、附子、熟地、山萸肉、山药、茯苓、丹皮、泽泻）合参蛤散（人参、蛤蚧）加减。越婢加半夏汤（C错）为肺胀痰热郁肺证的方剂应用。肺胀痰热郁肺证：【症状】咳逆，喘息气粗，胸满，目胀睛突，痰黄或白，黏稠难咳，烦躁，口渴欲饮，尿赤，大便干。舌边尖红，苔黄或黄腻，脉数或滑数。【方剂应用】基础方剂为越婢加半夏汤（麻黄、石膏、生姜、大枣、甘草、半夏）或桑白皮汤（桑白皮、半夏、苏子、杏仁、贝母、黄芩、黄连、山栀）加减。苏子降气汤（E错）为肺胀痰浊阻肺证的方剂应用。肺胀痰浊阻肺证：【症状】胸膺满闷，短气喘息，稍劳即著，咳嗽痰多，色白黏腻或呈泡沫，畏风易汗，脘痞纳少，倦怠乏力。舌暗，苔薄腻或浊腻，脉小滑。【方剂应用】基础方剂为苏子降气汤（紫苏子、半夏、前胡、厚朴、陈皮、甘草、当归、生姜、大枣、肉桂）合三子养亲汤（紫苏子、白芥子、莱菔子）加减。